男性，16岁。右下后牙咬硬物时略感不适1年余。口腔检查：牙列整齐，牙周检查（-），右下5叩诊（+），颊侧牙龈有窦道，松动I°，牙体未见明显龋坏，（牙合）面可见圆形黑环。最可能的诊断是
A. 隐匿龋
B. 牙隐裂
C. 牙周炎
D. 畸形中央尖
E. （牙合）面过度磨损

正确答案：D。畸形中央尖

解析：本题考查畸形中央尖。男性，16岁。右下后牙咬硬物时略感不适1年余。口腔检查：牙列整齐，牙周检查（-），右下5叩诊（+），颊侧牙龈有窦道，松动I°，牙体未见明显龋坏，（牙合）面可见圆形黑环。最可能的诊断是畸形中央尖（D对）。畸形中央尖患牙萌出后，由于高耸的中央尖位于咬合面，随着牙冠不断萌出，当与对颌牙产生咬合接触时，尖细型的中央尖极易断裂，中央尖折断或被磨损后，临床上表现为圆形或椭圆形黑环，根据以上特点可判断本题最可能的诊断是畸形中央尖。隐匿龋的病变区色泽较暗，有时用探针尖可探入洞中（A错）。牙隐裂的症状有激发痛、咬合痛、自发痛，疼痛程度与裂缝的深度相关，裂缝很难用肉眼发现（B错）。牙周炎的患者多伴有附着丧失和牙槽骨的吸收，同时可有牙周袋形成，牙齿有不同程度的松动（C错）。（牙合）面过度磨损可出现牙本质过敏现象，牙体组织受到物理或化学刺激时出现一过性的疼痛（E错）。